B细胞免疫功能测定的常用方法是
A. 外周血淋巴细胞计数
B. 免疫球蛋白测定
C. 血清补体测定
D. 抗“O”试验
E. 嗜异凝集试验

正确答案：B。免疫球蛋白测定

解析：免疫球蛋白测定是B细胞免疫功能测定的常用方法（B对）。外周血淋巴细胞计数是用于疾病以及癌肿的诊断（A错）。血清补体测定是用于检测各种急性炎症（C错）。抗“O”试验是用于检测与溶血性链球菌感染相关的疾病（D错）。嗜异凝集试验是用于诊断传染性单核细胞增多症的辅助实验（E错）。